环境影响评价基本方法说法错误的是
A. 环境现状调查的范围要小于评价范围
B. 可以采用收集资料法
C. 遥感法，能整体地了解环境质量状况，但精确度较差，一般作为辅助方法
D. 环境影响预测是要了解某区域环境在受到污染的过程中，有关环境质量参数在时间和空间上的变化量
E. 需要拟建项目工程概况

正确答案：A。环境现状调查的范围要小于评价范围